智商同为85，其一是山区农民，结合他受教育程度和所处环境，考虑其智力基本正常；其二是某大学教授，结合其他表现，考虑有大脑退行性改变的可能，这是遵循心理测验的
A. 标准化原则
B. 保密性原则
C. 客观性原则
D. 统一性原则
E. 以上都不是

正确答案：C。客观性原则